人绒毛膜促性腺激素（hCG）妊娠期间分论量达高峰的时期是
A. 妊娠4～6周
B. 妊娠8～10周
C. 妊娠12～14周
D. 妊娠16～18周
E. 妊娠20～22周

正确答案：B。妊娠8～10周